男，15岁，1个月前因学习退步被班主任批评后，渐起入睡困难，早醒，伴有情绪低落，自觉能力差，对前途悲观绝望，怀疑同学看不起他，嘲笑他，常自责，觉得对不起父母的培养，称活得太累，计划趁家人不备自杀。有时焦躁不安，用拳头砸墙发泄情绪。该患者目前的诊断是
A. 应激相关障碍
B. 精神分裂症
C. 抑郁发作
D. 双相障碍
E. 焦虑障碍

正确答案：C。抑郁发作

解析：患者男性青少年，情绪低落，意志活动减退，思维迟缓，负性认知模式（抑郁发作典型症状）；自责自罪，有自杀观念和行为，间或感到焦虑（精神病性症状）；有睡眠障碍，精力下降，砸拳发泄（躯体症状群），最可能的诊断是抑郁发作（C对）。双相障碍（D错）的诊断应有躁狂和抑郁反复循环或交替出现或混合方式存在。精神分裂症（B错）主要表现为幻觉、妄想。焦虑障碍（E错）主要表现为焦虑。应激相关障碍（A错）主要为一类与应激源有明显因果关系的精神障碍，包括创伤后应激障碍（PTSD）、延长哀伤障碍（如丧失亲人）、适应障碍（生活环境变化）。